患者，男。因胃肠道平滑肌痉挛而致腹痛，来药店购买颠茄片，应告知顾客不良反应有
A. 口干
B. 排尿困难
C. 视物模糊
D. 心率减慢
E. 便秘

正确答案：A、B、C、E。口干；排尿困难；视物模糊；便秘

解析：本题考查颠茄片的不良反应。颠茄为M受体阻断剂，能够抑制腺体分泌，松弛胃肠道平滑肌，不良反应包括：口鼻咽喉干燥（A对）、便秘（E对）、出汗减少、瞳孔散大、视物模糊（C对）、排尿困难（B对）、胃肠动力低下、胃食管反流等。